儿童多动症的主要症状不包括
A. 注意障碍
B. 活动过多
C. 冲动性
D. 学习困难
E. 行为良好

正确答案：E。行为良好

解析：本题考查儿童多动症的主要症状。注意缺陷多动障碍（ADHD）又称多动症，指表现出持续的与年龄不相符的注意力不集中（A对）、活动过多（B对）和冲动（C对）为核心症状的儿童，可造成儿童的学业、职业表现，情感，认知功能，社交等多方面的损害，是儿童期常见的神经发育障碍之一 。同时可合并品行障碍、对立违抗障碍、情绪障碍、学习困难（D对）等多种心理病理表现。行为良好（E错，为本题正确答案）不属于儿童多动症的症状。